不能伸髋关节的肌是
A. 半腱肌
B. 半膜肌
C. 股二头肌
D. 臀大肌
E. 臀中肌

正确答案：E。臀中肌

解析：半腱肌（A对）和半膜肌（B对）的作用都是屈膝、伸髋和使已屈的膝关节旋内。股二头肌（C对）屈膝、伸髋和使已屈的膝关节旋外。臀大肌（D对）使髋关节伸和旋外。臀中肌（E错，为本题正确答案）使髋关节外展、旋内（前部肌束）和旋外（后部肌束），而不能伸髋关节。